有关活髓切断术的叙述，哪一项是不必要的
A. 术前口服抗生素
B. 局部麻醉，橡皮障隔湿
C. 去净腐质，消毒窝洞
D. 去净髓室顶，切除冠髓
E. 止血、放盖髓剂、氧化锌丁香油暂封窝洞

正确答案：A。术前口服抗生素

解析：本题考查活髓切断术。对于术前口服抗生素（A错，为本题的正确答案）是没有必要的，首先盖髓剂本身具有消炎杀菌的效果，并且活髓切断术可将已感染的牙髓切掉，而且口服抗生素对牙髓抗感染的作用基本没有。活髓切断术即牙髓切断术，是切除炎症牙髓组织，以盖髓剂覆盖于牙髓断面，保留正常牙髓组织的方法。具体操作时，先隔湿患牙，对患牙进行局部麻醉，橡皮障隔湿（B对）。然后用器械制备洞形，去净腐质，消毒窝洞（C对）。确定髓腔入口部位，去净髓室顶后用球钻或挖匙切除冠髓（D对）。最后止血、放盖髓剂、氧化锌丁香油暂封窝洞（E对）。